一般情况下，全口覆盖式种植义齿种植体数量为
A. 1～3个
B. 4～6个
C. 7～8个
D. 看情况而定
E. 愈多愈好

正确答案：D。看情况而定

解析：本题考查种植义齿的组成和修复治疗原则。全口覆盖义齿的支持力有颌骨条件、植入种植体的数目以及部位所决定（D对）。若植入2枚种植体，种植义齿以基托下组织支持为主，种植体起固位和辅助支持作用；若植入3～4枚种植体，则种植义齿有种植体、附着体、基托下组织联合支持；植入4～6枚种植体，则以种植体支持为主。